下列哪项不符合中央性（完全性）前置胎盘的常见临床表现
A. 胎位不正的发生率高
B. 先露高浮
C. 第一次出血多在孕36周以后
D. 易发生出血性休克
E. 较其他类型前置胎盘易发生胎儿宫内窘迫

正确答案：C。第一次出血多在孕36周以后

解析：中央型前置胎盘第一次出血多在28周。以胎盘边缘与宫颈内口的关系，将前置胎盘分为3种类型。1)完全性前置胎盘或称中央性前置胎盘，宫颈内口全部被胎盘组织所覆盖。2)部分性前置胎盘宫颈内口的一部分被胎盘组织所覆盖。3)边缘性前置胎盘胎盘边缘附着于子宫下段甚至达宫颈内口但不超越宫颈内口。掌握“前置胎盘”知识点。